苯二氮䓬类药物对离子通道的作用是
A. 增加Cl⁻通道开放频率
B. 延长Cl⁻通道开放时间
C. 延长K⁺通道开放时间
D. 延长Na⁺通道开放时间
E. 增加K⁺通道开放频率

正确答案：A。增加Cl⁻通道开放频率

解析：本题考查苯二氮䓬类抗癫痫药。苯二氮䓬类药物对离子通道的作用是增加Cl⁻通道开放频率（A对）。BZ与GABAA受体结合后，引发受体蛋白构象变化（易化GABAA受体），促进GABA与GABAA受体结合，使Cl⁻通道开放的频率增加，细胞膜超级化，使GABA能神经的抑制功能增强。